中药五味中涩味的作用与下述哪种味相似
A. 辛味
B. 甘味
C. 苦味
D. 酸味
E. 咸味

正确答案：D。酸味

解析：涩味多与酸味作用相似，具有收敛固涩的作用（D对）。辛味（A错）能散能行，具有发散、行气、行血的作用。甘味（B错）能补能和能缓，具有补益、和中、调和药性和缓急止痛的作用。苦味（C错）能泄、能燥、能坚，具有清热泻火，通泄大便，燥湿，坚阴等作用。咸味（E错）能下、能软，具有泻下通便，软坚散结的作用。